Mφ不表达
A. C3b受体
B. 细胞因子受体
C. IgG Fc受体
D. MHCⅡ分子
E. mlg

正确答案：E。mlg